只用于衡量体格指标的发育提前或者滞后状况的发育年龄是
A. 骨骼年龄
B. 牙齿年龄
C. 形态年龄
D. 第二性征年龄
E. 心理年龄

正确答案：C。形态年龄